某男患者，23岁，被确诊为再生障碍性贫血而住入某院。患者认为“再障”是不治之症而拒绝一切治疗措施，甚至摔碎注射器。医务人员始终保持积极、耐心、和蔼的态度，一方面反复开导，讲解有关知识，陈述利害关系，另一方面精心治疗，获得患者信任。在患者主动配合下，通过中西医结合治疗，使患者好转出院。这个患者出院至今已生存20余年，并建立了幸福的家庭。在这个患者的治愈过程中，以下哪点说法不够准确
A. 患者不仅有受动的一面，更有能动的一面
B. 医务人员通过教育和疏导，变患者的顽固拒医行为为积极求医行为，变病人消极悲观态度为积极乐观态度，是诊治成功的关键
C. 打动患者心灵，改变患者态度，是医务人员的道德责任
D. 医务人员的权威性是至高无上的
E. 把患者的思想工作放在首位是正确的

正确答案：D。医务人员的权威性是至高无上的